某男，50岁。体胖，久患瘰疬，近日新患肺热咳喘、痰黄，医师在处方时将海蛤壳与海浮石同用，此因二药均能
A. 清热化痰、软坚散结
B. 清热化痰、活血散结
C. 清宣肺气、化痰散结
D. 消痰化瘀、止咳平喘
E. 清肺化痰、消肿散结

正确答案：A。清热化痰、软坚散结

解析：本题考查海蛤壳与海浮石的功效。医师在处方时将海蛤壳与海浮石同用，此因二药均能清热化痰、软坚散结（A对）。海蛤壳【功效】清热化痰，软坚散结，利尿消肿，制酸止痛。海浮石【功效】清热化痰，软坚散结，通淋。天竺黄、海蛤壳、海浮石，均性寒而能清热化痰，治痰热咳喘。浙贝母【功效】清热化痰，散结消肿（B错）。猫爪草【功效】化痰散结（C错），解毒消肿。紫苏子【功效】降气化痰，止咳平喘（D错），润肠通便。瓜蒌【功效】清肺润燥化痰，利气宽胸，消肿散结（E错），润肠通便。